胃肠道内防碍氨吸收的主要因素是
A. 胆汁分泌减少
B. 蛋白质摄入减少
C. 肠道细菌受抑制
D. 血液中尿素浓度下降
E. 肠内PH小于5

正确答案：E。肠内PH小于5

解析：胃肠道内防碍氨吸收的主要因素是肠内PH小于5（E对）。